正确描述膀胱的是
A. 属于腹膜内位器官
B. 最下为膀胱底
C. 尿道内口位于膀胱尖处
D. 膀胱体的下方为前列腺
E. 空虚时全位于小骨盆腔内

正确答案：E。空虚时全位于小骨盆腔内

解析：膀胱为腹膜间位器官（A错），最下部称膀胱颈（B错）。尿道内口为输尿管的开口，位于膀胱底（C错）。前列腺（D错）位于膀胱颈下方。膀胱空虚时全部位于盆腔内（E对）。